某男，56岁。口渴引饮，能食易饥，大便溏薄，精神不振，四肢乏力；舌淡，苔薄白而干，脉细弱无力。空腹血糖为10.2mmol/L，糖化血红蛋白为8%。根据辨证结果，宜选用的基础方剂是
A. 六味地黄丸
B. 生脉散
C. 金匮肾气丸
D. 玉女煎
E. 参苓白术散

正确答案：E。参苓白术散

解析：本题考查脾消渴之胃气虚证的方剂应用。根据治法，宜选用的基础方剂是参苓白术散（E对）。消渴之脾胃气虚证【症状】口渴引饮，能食与便溏并见，或饮食减少，精神不振，四肢乏力。舌淡，苔薄白而干，脉细弱无力。【治法】健脾益气。【方剂应用】基础方剂参苓白术散（莲子肉、薏苡仁、砂仁、桔梗、白扁豆、白茯苓、人参、甘草、白术、山药）加减。消渴之肾阴亏虚证【症状】尿频量多，浊如膏脂，腰酸膝软，头晕耳鸣，多梦遗精，乏力，皮肤干燥。舌红少苔，脉细数。【治法】滋养肾阴。【方剂应用】基础方剂六味地黄丸（A错）（熟地黄、山萸肉、山药、泽泻、丹皮、茯苓）加减。消渴之气阴两虚证【症状】口渴引饮，咽干口燥，多食善饥，倦怠乏力，便溏溲多，或形体消瘦。舌质淡红，苔白而干，脉弱。【治法】益气健脾，生津止渴。【方剂应用】基础方剂七味白术散（人参、茯苓、白术、藿香叶、木香、甘草、葛根）加减，可合生脉散（B错）益气生津止渴。消渴之阴阳两虚证【症状】小便频数，甚则饮一溲一，咽干舌燥，面容憔悴，耳轮干枯，腰膝酸软，畏寒肢冷。舌淡，苔白少津，脉沉细无力。【治法】温阳滋肾。【方剂应用】基础方剂肾气丸（C错）（地黄、山药、山萸肉、泽泻、茯苓、丹皮、桂枝、附子）加减。消渴之阴虚燥热证【症状】烦渴引饮，消谷善饥，小便频数而多，尿浑而黄，形体消瘦。舌红，苔薄黄，脉滑数。【治法】养阴润燥。【方剂应用】基础方剂玉女煎（D错）（生石膏、熟地、麦冬、知母、牛膝）加减。